生物药剂学分类系统根据药物溶解性和肠壁渗透性的不同组合将药物分为四类。阿替洛尔属于第Ⅲ类，是高水溶性、低渗透性的水溶性分子药物，其体内吸收取决于
A. 渗透效率
B. 溶解速率
C. 胃排空速度
D. 解离度
E. 酸碱度

正确答案：A。渗透效率

解析：本题考查生物药剂学分类系统。生物药剂学分类系统根据药物溶解性和肠壁渗透性的不同组合将药物分为四类，阿替洛尔属于第Ⅲ类，是高水溶解性、低渗透性的水溶性分子药物，制约吸收速率的因素是跨膜作用，故体内吸收受渗透效率影响（A对）。第I类是高水溶解性、高渗透性的两亲性分子药物，其体内吸收取决于胃排空速率（C错），如普萘洛尔；第Ⅱ类是低水溶解性、高渗透性的亲脂性分离药物，肠内溶出是其限速过程，故取决于溶解速率（B错），如卡马西平；第IV类是低水溶解性、低渗透性的疏水性分子药物，多种因素制约其吸收速率，如呋塞米。